足三阴经相同的主治是
A. 肝病、脾胃病
B. 肾病、脾胃病
C. 肺病、脾病、肾病
D. 妇科病、腹部病
E. 前阴病、妇科病

正确答案：D。妇科病、腹部病

解析：某一经脉所属的经穴均可治疗该经循行部位及相应脏腑的病证。足三阴经均可治疗妇科病，腹部病（D对）。